软垢覆盖面积占牙面2/3以上，根据DI-S记分标准为
A. 0
B. 1
C. 2
D. 3
E. 4

正确答案：D。3

解析：本题考查牙周病流行病学及分级预防。软垢覆盖面积占牙面2/3以上，根据DI-S记分标准为3（D对）。DI-S：0＝牙面上无软垢；1＝软垢覆盖面积占牙面1/3以下；2＝软垢覆盖面积占牙面1/3与2/3之间；3＝软垢覆盖面积占牙面2/3以上。